关于避孕措施和患者教育的说法，正确的有
A. 新婚期可选择复方短效口服避孕药
B. 复方短效口服避孕药一般停药后即可妊娠
C. 长效避孕药一般停药6个月后妊娠较安全
D. 哺乳期选用雌、孕激素复合避孕针比单孕激素长效避孕针安全
E. 绝经过渡期原来使用宫内节育器无不良反应者可继续使用至绝经后半年再取出

正确答案：A、B、C、E。新婚期可选择复方短效口服避孕药；复方短效口服避孕药一般停药后即可妊娠；长效避孕药一般停药6个月后妊娠较安全；绝经过渡期原来使用宫内节育器无不良反应者可继续使用至绝经后半年再取出

解析：本题考查避孕保健。新婚期避孕一般选择短效口服避孕药（A对）、阴茎套。短效口服避孕药在体内代谢快，停药后即可妊娠（B对）；长期口服避孕药在体内排泄慢，需停药6个月之后受孕才比较安全（C对）。哺乳期为防止药物对婴儿造成影响，须采用阴茎套避孕，尤其不能使用长效口服避孕药；可选用单孕激素长效避孕针，但不宜使用雌、孕激素复合避孕针（D错）。绝经后0.5～1年受孕概率极小，可去除宫内节育器（E对）。